下列关于PPD试验的说法最准确的是
A. 凡是PPD试验阴性可除外结核病
B. PPD试验阳性可肯定有结核病
C. 粟粒型肺结核PPD试验有时可呈阳性
D. 初次感染结核菌后2周，PPD试验呈阳性
E. 卡介苗接种成功，PPD试验呈强阳性

正确答案：C。粟粒型肺结核PPD试验有时可呈阳性

解析：PPD试验即结核菌素试验，其广泛应用于检出结核分枝杆菌的感染，而非检出结核病（AB错）。由于许多国家和地区广泛推行卡介苗接种，结核菌素试验阳性不能区分是结核分枝杆菌的自然感染还是卡介苗接种的免疫反应。结核分枝杆菌感染后需4～8周才能建立充分的变态反应，在此之前，结核菌素试验可呈阴性（DE错）；营养不良、HIV感染、麻疹、水痘、癌症、严重的细菌感染包括重症结核病如粟粒型结核和结核性脑膜炎等，结核菌素试验结果则多为阴性或弱阳性，有时可呈阳性（C对）。